男，38岁。车祸致胸部损伤，出现严重呼吸困难，查体：BP80/60mmHg，脉细速，皮肤完整，气管左移，颈静脉充盈，颈部及右胸部皮下气肿，右胸饱满，肋间隙增宽，叩鼓音，右肺呼吸音消失。最可能的诊断是
A. 张力性气胸
B. 闭合性气胸
C. 开放性气胸
D. 纵隔气肿
E. 肺爆震伤

正确答案：A。张力性气胸

解析：青年男性患者，车祸致胸部损伤后，出现严重呼吸困难（提示有肺部损伤），查体见气管左移，颈静脉充盈，颈部及右胸部皮下气肿，右胸饱满，肋间隙增宽，叩诊呈鼓音，右肺呼吸音消失，提示可能为气胸且症状较重。BP80/60mmHg（正常值为90～140/60～90mmHg，提示有循环功能障碍），皮肤完整（提示为非开放性损伤），结合患者病史、症状和体征，最可能的诊断为右侧张力性气胸（A对）。闭合性气胸（B错）患者症状较轻，一般无颈静脉充盈和皮下气肿。开放性气胸（C错）指胸壁皮肤、软组织及壁层胸膜破损，使胸膜腔与外界相通，该患者皮肤完整，故不选。纵隔气肿（D错）积气量大者，可有呼吸困难、颈静脉怒张，但一般不会出现右胸饱满、叩诊鼓音、呼吸音消失等症状。肺爆震伤（E错）指由爆炸产生的高压气浪或水波浪冲击损伤肺组织，轻者仅有短暂的胸痛、胸闷或憋气感，稍重者可出现咳嗽、咯血或血丝痰等表现。